心脏舒缩活动协调性减弱的原因是
A. 钠-钙交换体与Ca2+亲和力下降
B. 心肌收缩性减弱
C. 心肌室壁增厚、纤维化
D. 心律失常
E. 心肌去甲肾上腺素合成减少

正确答案：D。心律失常

解析：心律失常（D对）时，心脏病变区域生理特性发生改变，非病变区域生理特性相对正常，处于不同状态的心肌同时进行舒缩活动可造成心脏舒缩活动协调性减弱。